具有燥湿功效的药物是
A. 蒲公英
B. 紫花地丁
C. 鱼腥草
D. 穿心莲
E. 青黛

正确答案：D。穿心莲

解析：该题考查穿心莲的功效，属记忆内容。穿心莲味苦，性寒；入心、肺、大肠、膀胱经；其功效为清热解毒，凉血，消肿，燥湿（D对）。蒲公英具有清热解毒，消肿散结，利湿通淋的功效，无燥湿之功（A错）。紫花地丁具有清热解毒，凉血消肿的功效（B错）。鱼腥草具有清热解毒，消痈排脓，利尿通淋的功效（C错）。青黛具有清热解毒，凉血消斑，清肝泻火，定惊的功效，无燥湿之功（E错）。